因抑制血管内皮的前列腺素的生成，使血管内的前列腺素和血小板中的血栓素动态平衡失调而致血栓形成风险增加的非甾体抗炎药是
A. 阿司匹林
B. 双氯芬酸
C. 塞来昔布
D. 吲哚美辛
E. 布洛芬

正确答案：C。塞来昔布

解析：本题考查非甾体抗炎药。塞来昔布（C对）通过抑制血管内皮的前列腺素生成，使血管内的前列腺素和血小板中的血栓素动态平衡失调，导致血栓素升高，有血栓形成风险；阿司匹林（A错）、双氯芬酸（B错）、吲哚美辛（D错）、布洛芬（E错）均属于非选择性环氧酶抑制剂。